急性肾炎出现明显水肿及少尿，应选用
A. 限制水盐及卧床休息
B. 二氮嗪
C. 速尿
D. 利血平
E. 西地兰

正确答案：C。速尿

解析：呋塞米又称速尿，利尿作用强，主要用于其他利尿药无效的严重水肿，急性肾炎出现明显水肿尿少应选用速尿（C对）。水肿、高血压者应限盐及限水。急性期必须卧床休息2～3周（A错）。二氮嗪用于治疗高血压危象，高血压脑病，幼儿特发性低血糖等（B错）。利血平主要用于轻、中度高血压患者（D错）。发生急性心衰时，应纠正心衰，用西地兰快速强心（E错）。